异丙肾上腺素作用于
A. M受体
B. β受体
C. 5-HT受体
D. 多巴胺受体
E. 苯二氮䓬受体

正确答案：B。β受体

解析：本题考查异丙肾上腺素。异丙肾上腺素作用于β受体（B对）。异丙肾上腺素对β₁、β₂受体均有强大的激动作用，对α受体几乎无作用。作用于M受体（A错）的药物M受体阻断剂阿托品等和M受体激动剂毛果芸香碱等。作用于5-HT受体（C错）的药物是抗抑郁药，如氟西汀、文拉法辛、米氮平等。作用于多巴胺受体（D错）的药物有甲氧氯普胺等。作用于苯二氮䓬受体（E错）的药物是镇静催眠药，如地西泮、氟西泮等。